除妊娠及哺乳妇女外，其他禁用伪麻黄碱的人群是
A. 甲状腺功能减退者
B. 高尿酸血症者
C. 支气管哮喘
D. 良性前列腺增生者
E. 功能性便秘者

正确答案：D。良性前列腺增生者

解析：本题考查伪麻黄碱的禁忌症。除妊娠及哺乳妇女外，其他禁用伪麻黄碱的人群是良性前列腺增生者（D对）。口服含伪麻黄碱制剂的老年患者和心脏病、高血压、甲状腺疾病、糖尿病、前列腺肥大、青光眼、抑郁症及哮喘等患者、12岁以下儿童在使用前应向医师咨询。